成组匹配病例对照研究
A. 使所要求配比的因素所占的比例在病例组和对照组一致
B. 以病例和对照的个体为单位，根据一定条件进行配比
C. 两者均是
D. 两者均否

正确答案：A。使所要求配比的因素所占的比例在病例组和对照组一致

解析：本题考查成组匹配病例对照研究的概念。成组匹配病例对照研究即要求选择的对照在某些因素或特征上与病例保持一致（A对CD错），目的是使匹配因素在病例组与对照组之间保持均衡，从而排除这些因素对结果的干扰。以病例和对照的个体为单位，根据一定条件进行配比（B错）是个体匹配病例对照研究的内容。